K⁺通道具有抑制作用，可诱发药源性心律失常的是
A. 伐昔洛韦
B. 阿奇霉素
C. 特非那定
D. 酮康唑
E. 沙丁胺醇

正确答案：C。特非那定

解析：本题考查药物化学结构与生物活性。对hERG K⁺通道具有抑制作用，可诱发药源性心律失常的是特非那定（C对）。伐昔洛韦（A错）用于治疗水痘带状疱疹及Ⅰ型、Ⅱ型单纯性疱疹病毒感染，包括初发和复发的生殖器疱疹病毒感染。阿奇霉素（B错）为大环内酯类抗生素。酮康唑（D错）属于唑类抗真菌药。沙丁胺醇（E错）用于治疗哮喘。